检查乳房的最佳时间是
A. 经前
B. 经后3天
C. 经后7~10天
D. 经后2周
E. 经后3周

正确答案：C。经后7~10天

解析：乳房生理最平稳的时期是在月经来潮的第7-10天，因此乳房有病变在此期容易被发现（C对）。一般在月经前7~10天，受体内雌激素影响，乳腺导管系统扩张，终末乳管及小叶内上皮细胞增大增多。乳腺腺泡形成，腺小叶出现。此时，乳管周围的结缔组织增生并呈水肿样，乳腺导管与乳腺小叶内可见分泌物积存。临床表现为乳房体积增大、变硬，常感胀痛。体检时能发现乳腺增厚，有时会触及结节并伴疼痛或压痛，甚至还会分泌少量液体（A错）。经后3天，激素仍对乳房有影响，乳房未复原（B错）。经后两周，激素水平又开始上升，乳房开始改变（D错）。经后3周，激素又回到经前水平（E错）。